小儿“纯阳”之体的含义是
A. 阴亏阳亢
B. 纯阳无阴
C. 阳常有余
D. 发育迅速
E. 肝常有余

正确答案：D。发育迅速

解析：《颅囟经·脉法》说：“凡孩子3岁以下，呼为纯阳，元气未散”。所谓“纯”，指小儿未经情欲克伐、胎元之气尚未耗散；所谓“阳”，即以阳为用。“纯阳”是说明小儿生机蓬勃，发育迅速，好比旭日之初生，草木之方萌，蒸蒸日上、欣欣向荣的蓬勃景象（D对）。阴亏阳亢（A错），即阴虚阳亢，为病机特点，正常情况下，阴阳相互平衡，若阴不足而造成的阳相对偏亢，就称为阴虚阳亢，表现为五心烦热、潮热盗汗，干咳少痰，或遗精，舌红少苔，脉细数等症状。纯阳无阴（B错），指阳气偏亢、阴气耗竭，为危重证候。朱丹溪认为饮食失节，嗜酒纵欲，伤伐过度，则阳热易亢，虚火妄动，故阳常有余（C错），为病理特点。肝常有余（E错）为小儿病理特点之一，小儿患病最易出现高热、惊风，这是由于小儿脏腑娇嫩，感受病邪，每易邪气枭张而壮热，同时小儿神气怯弱，邪易深入，邪气盛则实，内陷心包则惊悸、昏迷，肝得心火则抽搐，肝风心火，交相煽动，则火热炽盛，真阴内亏，柔不济刚，筋脉失养，故壮热、惊搐、昏迷，甚则角弓反张。